我国成立全国牙病防治指导小组是在
A. 1984年
B. 1986年
C. 1988年
D. 1990年
E. 1992年

正确答案：C。1988年

解析：本题考查我国成立全国牙病防治指导小组的时间。1988年（C对），我国成立全国牙病防治指导小组，标志着我国开始逐渐认识到口腔保健的重要性。全国牙病防治指导小组成立后开展了一系列的口腔健康教育和口腔健康促进活动，促进了我国口腔预防事业的发展，缩短了与国际的差距。